正确描述三叉神经的是
A. 含有特殊内脏运动纤维和一般躯体感觉纤维
B. 含有特殊内脏运动纤维和特殊内脏感觉纤维
C. 不管理咀嚼肌运动
D. 传导舌后1／3的粘膜感觉
E. 传导舌后1／3的味觉

正确答案：A。含有特殊内脏运动纤维和一般躯体感觉纤维

解析：三叉神经为混合性脑神经，含有特殊内脏运动纤维和一般躯体感觉纤维（A对B错）。一般躯体感觉纤维传导头面部、口鼻腔皮肤黏膜的浅感觉；特殊内脏运动纤维管理咀嚼肌运动（C错）。传导舌后1／3的粘膜感觉（D错）、舌后1／3的味觉（E错）均为舌咽神经的功能。